属于抗凝异常的实验室检查是
A. 血vWF测定
B. PF₃有效性测定
C. 血栓素B₂测定
D. 血PC测定
E. 血D-二聚体测定

正确答案：D。血PC测定

解析：抗凝异常的实验室检查有：①AT（抗凝血酶）抗原及活性或凝血酶-抗凝血酶复合物（TAT）测定；②PC（D对）、PS及TM测定；③FⅧ：C抗体测定；④狼疮抗凝物或心磷脂类抗体测定。血vWF测定（P610）（A错）是血管异常的实验室检查；PF₃有效性测定（B错）是反映血小板功能的实验室检查；血栓素B₂测定（C错）主要用于血栓性疾病的监测；血D-二聚体测定（P610）（E错）是纤溶异常的实验室检查。